下列能导致肾小球滤过率增高的因素是
A. 肾小球毛细血管血压下降
B. 血浆胶体渗透压下降
C. 血浆晶体渗透压下降
D. 肾小囊内压升高
E. 肾血流量减少

正确答案：B。血浆胶体渗透压下降